不会产生戒酒硫样反应的药物是
A. 甲硝唑
B. 呋喃唑酮
C. 氯磺丙脲
D. 抗坏血酸
E. 头孢孟多

正确答案：D。抗坏血酸